在嵌入性脱位的患牙发生牙髓坏死率为
A. 0.56
B. 0.66
C. 0.76
D. 0.96
E. 0.86

正确答案：D。0.96

解析：本题考查嵌入性脱位的牙髓坏死率。牙受外力作用而脱离牙槽窝者称牙脱位，包括嵌入性脱位、部分脱位和完全脱位。牙髓坏死发生率占牙脱位的52％，嵌入性脱位的患牙发生牙髓坏死率为96％（D对）。